胃苏颗粒除理气消胀外，又能
A. 制酸止痛
B. 消食止痛
C. 散寒止痛
D. 缓急止痛
E. 和胃止痛

正确答案：E。和胃止痛

解析：本题考查的是胃苏颗粒的功能。胃苏颗粒除理气消胀外，又能和胃止痛（E对）。胃苏颗粒【功能】理气消胀，和胃止痛。乌贝颗粒【功能】收敛止血，制酸止痛（A错）。四味脾胃舒片【功能】健脾和胃，消食止痛（B错）。附桂风湿膏【功能】祛风除湿，散寒止痛（C错）。阴虚胃痛颗粒【功能】养阴益胃，缓急止痛（D错）。